治疗系统性红斑狼疮选用
A. 甲硝唑
B. 甲苯咪唑
C. 吡喹酮
D. 氯喹
E. 恩波维铵

正确答案：D。氯喹

解析：本题考查氯喹。治疗系统性红斑狼疮选用氯喹（D对）。大剂量氯喹能抑制免疫反应，偶尔用于类风湿关节炎，也用于系统性红斑狼疮。甲硝唑（A错）可作为阴道滴虫病和阿米巴病的首选药。甲苯咪唑（B错）是治疗蛔虫病、蛲虫病、钩虫病和鞭虫病的首选药。吡喹酮（C错）是广谱的抗蠕虫药物，尤其对血吸虫具有很强杀灭作用。恩波维铵（E错）是治疗蛲虫病的首选药。